男，32岁。反复皮肤紫癜1个月，加重并腹痛2天。查体：四肢皮肤散在紫癜，心肺未见异常，腹平软，脐周轻压痛，无反跳痛和肌紧张，肝脾肋下未触及，肠鸣音6次/分。临床诊断为过敏性紫癜。该患者目前不适合的治疗药物是
A. 维生素C
B. 泼尼松
C. 芦丁片
D. 山茛菪碱
E. 低分子肝素

正确答案：E。低分子肝素

解析：该患者除有四肢皮肤散在紫癜外，还有腹痛和脐周轻压痛等腹部症状，最有可能的临床类型是腹型（Henoch型）过敏性紫癜。而低分子肝素（E错，为本题正确答案）适用于肾型过敏性紫癜患者。维生素C（A对）和曲克芦丁（C对）作为一般治疗药物，有助于改善血管通透性而改善病情。泼尼松（B对）有抑制抗原抗体反应、减轻炎症渗出、改善血管通透性等作用。山莨菪碱有助于缓解患者的腹痛症状。